在5S循证医学信息服务模式演进的过程中，所有其他证据衍生品的基础是
A. 原始研究
B. 系统综述
C. 证据概要
D. 综合证据
E. 证据系统

正确答案：A。原始研究